球结膜下水肿可见于
A. 动脉硬化
B. 结膜炎
C. 亚急性感染性心内膜炎
D. 输液过多
E. 沙眼

正确答案：D。输液过多

解析：球结膜透明而隆起为球结膜下水肿，可见于脑水肿或输液过多（D对）。动脉硬化（A错）患者可出现大片的结膜下出血。结膜炎（B错）患者可见球结膜充血黏膜发红。亚急性感染性心内膜炎（C错）患者可见球结膜有多少不等散在的出血点。沙眼（E错）患者可见球结膜存在颗粒与滤泡。